药品广告审查批准文号的有效期为
A. 2年
B. 3年
C. 5年
D. 1年
E. 7年零9个月

正确答案：A。2年

解析：本题考查药品广告审查批准文号的有效期。根据《药品广告审查办法》第十五条规定，药品广告批准文号有效期为1年（D对）。